丹参中水溶性成分是
A. 丹参酮Ⅰ
B. 丹参酮ⅡA
C. 丹参酮ⅡB
D. 隐丹参酮
E. 丹参酸甲

正确答案：E。丹参酸甲

解析：本题考查的是丹参的化学成分。丹参中水溶性成分是丹参酸甲（E对）。丹参的化学成分主要包括脂溶性成分和水溶性成分两大部分。脂溶性成分大多为共轭醌、酮类化合物。如丹参酮Ⅰ（A错）、丹参酮ⅡA（B错）、丹参酮ⅡB（C错）、隐丹参酮（D错）等。《中国药典》采用高效液相色谱法测定丹参中丹参酮类和丹酚酸B的含量，要求丹参酮ⅡA、隐丹参酮和丹参酮Ⅰ的总量不得少于0.25%，丹酚酸B不得少于3.0%。另外，水溶性成分则包括丹参素，丹参酸A、丹酚酸B，原儿茶酸，原儿茶醛等。